死亡的标志是
A. 脑死亡
B. 心跳停止
C. 呼吸停止
D. 瞳孔散大
E. 脑电波处于零电位

正确答案：A。脑死亡

解析：1968年，美国哈佛大学医学院死亡定义审查特别委员会正式提出将脑死亡（A对）作为人类个体死亡的判断标准。